患者，12岁，全口牙齿里均匀灰色，个别牙齿表面釉质缺损。诊断为
A. 氟斑牙
B. 四环素牙
C. 遗传性乳光牙本质
D. 釉质发育不全
E. 先天性梅毒牙

正确答案：B。四环素牙

解析：全口牙齿里均匀灰色，是四环素牙的典型特征，其他几个选项都不具备此特点，四环素牙对牙的影响主要是着色，但有时也合并釉质发育不全。掌握“四环素牙齿”知识点。